最常见的子宫内膜异位症病灶部位在
A. 子宫肌层
B. 卵巢
C. 宫颈
D. 直肠子宫陷凹
E. 宫骶韧带

正确答案：B。卵巢

解析：子宫内膜异位症是指子宫内膜组织（腺体和间质）出现在子宫体以外的部位。异位内膜可侵犯全身任何部位，如脐、膀胱、肾、输尿管、肺、胸膜、乳腺，甚至手臂、大腿等处，但绝大多数位于盆腔脏器和壁腹膜，其中以卵巢（B对）最常见。